脊髓的血供来源不包括
A. 脊髓前动脉
B. 节段性动脉
C. 前交通动脉
D. 脊髓后动脉
E. 无

正确答案：C。前交通动脉

解析：脊髓的血供来源有两个，椎动脉和节段性动脉（B对），其中椎动脉发出的两条分支分别叫做脊髓前动脉（A对）和脊髓后动脉（D对C错，为本题正确答案）。